A1DS患者最常发生的恶性肿瘤是
A. Burk1tt肉瘤
B. 霍奇金淋巴瘤
C. Kapos1肉瘤
D. 非霍奇金淋巴瘤
E. 脑原发性淋巴瘤

正确答案：C。Kapos1肉瘤

解析：卡波西肉瘤在艾滋病患者中较为常见，多见于男同性恋及男双性恋患者，也可见于静脉吸毒者。病变主要累及下肢皮肤和口腔黏膜、出现紫红色和深蓝色浸润斑或结节，并可发生糜烂、溃疡。这种恶性病变也可出现于淋巴结和内脏。确诊有赖于病理活检（C对）。